可出现嗜酸粒细胞减少的疾病是
A. 支气管哮喘
B. 伤寒
C. 荨麻疹
D. 钩虫病
E. 慢性粒细胞白血病

正确答案：B。伤寒

解析：嗜酸性粒细胞减少：见于伤寒（B对）、副伤寒、应激状态、休克、库欣综合征等。支气管哮喘（A错）、荨麻疹（C错）、钩虫病（D错）都可见嗜酸性粒细胞增多。慢性粒细胞白血病（E错）主要表现为粒细胞增多。